一烧伤患者，体温不升，呼吸气微，表情淡漠，神志恍惚，嗜睡，语言含糊不清，四肢厥冷，汗也淋漓，舌光无苔，脉细。其证候是
A. 火热伤津
B. 阴伤阳脱
C. 火毒内陷
D. 气血两伤
E. 脾胃虚弱

正确答案：B。阴伤阳脱

解析：火毒炽盛，伤津耗液，损伤阳气，致阴液伤阳气脱，阳气脱，不得温煦，则见体温不升，四肢厥冷，不能鼓动精神，则见呼吸气微，表情淡漠，神志恍惚，语言含糊，无力固摄，则汗也淋漓，舌光无苔，脉细为阴液大伤之象（B对）。患者表现为阴阳两伤的症状，且病情较重，火热伤津不够精确（A错）。火毒内陷应表现为一派火毒及火毒传至脏腑之表现，可见壮热，躁动不安，舌红绛，苔黄或焦黑，脉弦数（C错）。气血两伤出现在烧伤后期，无阳虚症状，以气血两虚表现为主，可见气短懒言，精神疲倦，面色淡白无华，自汗，舌淡苔白，脉细弱（D错）。脾胃虚弱即可见气血两虚，又有脾胃虚弱的独特表现，如纳呆，便溏，四肢无力等，舌淡苔白，脉细弱（E错）。